探测附着水平丧失程度是为了
A. 判断牙龈炎症程度
B. 判断牙周炎症程度
C. 判断牙槽骨吸收程度
D. 判断牙周组织破坏程度
E. 鉴别牙龈炎和牙周炎

正确答案：D。判断牙周组织破坏程度

解析：本题考查探测附着水平丧失程度的目的。牙周附着水平是指龈沟底或牙周袋底至釉牙骨质界的距离，牙周组织的破坏程度以附着丧失的程度来表示。正常牙周组织龈沟底应附着于釉牙骨质界水平或釉牙骨质界的冠方。当牙周组织发生破坏时，结合上皮发生退缩，结合上皮的冠方即牙周袋底的位置位于釉牙骨质界的根方，牙周组织破坏越严重，退缩越多，牙周袋底的位置距离釉牙骨质界越远。因此探测附着水平丧失程度是为了判断牙周组织破坏程度（D对）。